冈崎片段的生成是由于
A. 真核生物有多个复制起始点
B. 拓扑酶的作用
C. RNA引物合成不足
D. 随从链的复制与解链方向相反
E. DNA连接酶缺失

正确答案：D。随从链的复制与解链方向相反